病例对照研究的研究对象分为
A. 试验组与非试验组
B. 病例组与对照组
C. 干预组与对照组
D. 暴露组与非暴露组
E. 研究组与非研究组

正确答案：B。病例组与对照组

解析：本题考查病例对照研究的研究对象。病例对照研究的研究对象按是否具有研究的结局分成病例组与对照组（B对ACDE错）。